与妊娠高血压综合征无关的是
A. 双胎妊娠
B. 胎盘早剥
C. 前置胎盘
D. 羊水过多
E. 胎儿窘迫

正确答案：C。前置胎盘

解析：前置胎盘主要由于胎盘附着于子宫下段、下缘达到或覆盖宫颈内口，位置低于胎先露部，与子宫内膜病变或损伤、胎盘异常、受精卵滋养层发育迟缓有关，与血压升高关系不大，故与妊娠期高血压综合征无关（C对）。双胎妊娠（P121）（A错）时孕妇需要的营养和氧更多，从而使孕妇的血容量增加更多，更易发生妊娠期高血压综合征，流行病学发现双胎妊娠与妊娠期高血压的发生密切相关。妊娠期高血压综合征的孕妇可因底蜕膜螺旋小动脉痉挛或硬化，引起远端毛细血管变性坏死，血液在底蜕膜层与胎盘之间形成胎盘后血肿，使胎盘与子宫壁分离，形成胎盘早剥（B错）。妊娠期高血压综合征（D错）使血管中的水分更易进入羊膜腔，可导致羊水过多。